耳屏前方触摸到的搏动
A. 颈外动脉
B. 耳前动脉
C. 颞浅动脉
D. 面横动脉
E. 上颌动脉

正确答案：C。颞浅动脉

解析：颞浅动脉（C对）位置表浅，在耳屏前方即外耳门的前上方、颞弓的根部可摸到其搏动。